工业废气排放标准是指
A. 工厂四周监测污染物数量
B. 工厂烟囱或排气洞口排放废气中污染物数量
C. 工厂烟卤烟波着陆点测出污染物数量
D. 工人活动范围内监测污染物数量
E. 工厂四周100m范围内监测污染物数量

正确答案：B。工厂烟囱或排气洞口排放废气中污染物数量

解析：本题考查工业废气排放标准。工业废气排放标准是指工厂烟囱或排气洞口排放废气中污染物数量（B对ACDE错）。